原位癌是
A. 良性肿瘤
B. 恶性肿瘤
C. 交界性肿瘤
D. 癌前病变
E. 非肿瘤性良性病变

正确答案：B。恶性肿瘤

解析：原位癌指异型增生的细胞在形态和生物学特性上与癌细胞相同，常累及上皮的全层，但没有突破基底膜向下浸润，有时也称为上皮内癌的一种病变，是一种恶性肿瘤（B对）。交界性肿瘤（C错）属于一种介于良性和恶性之间的肿瘤。癌前病变（D错）指某些疾病的本质不是恶性肿瘤，但具有发展为恶性肿瘤的潜能，患者发生相应恶性肿瘤的风险增加。非肿瘤性良性病变（E错）可见于修复、炎症等情况，不属于肿瘤范围。